中国药典用银量法测定苯巴比妥的含量，指示终点的方法是
A. 铬酸钾法
B. 铁铵矾指示剂法
C. 吸附指示剂法
D. 电位法
E. 永停法

正确答案：D。电位法